胆囊切除术中需探查胆总管的指证是
A. 胆囊壁明显增厚
B. 胆囊增大
C. 胆总管直径＞1cm
D. 胆囊结石超过2cm
E. 胆囊结石伴有胆囊息肉

正确答案：C。胆总管直径＞1cm

解析：胆囊切除术中需探查胆总管的指征有（P440）（1）术前病史或检查提示胆总管有梗阻；（2）术中证实胆总管有病变；（3）胆总管扩张直径超过1cm（C对），胆囊壁明显增厚，发现胰腺炎或胰头肿物，胆管穿刺出脓性、血性胆汁或泥沙样胆色素颗粒；（4）胆囊结石小，可能进入胆总管。胆囊壁明显增厚（＞3mm）（A错）；胆囊结石超过2cm（D错）；胆囊结石伴有胆囊息肉（E错）均为胆囊切除术的手术适应证。胆囊増大（B错）不是胆囊切除术亦非探查胆总管指证。